男孩，10岁。因2天来发热，1天来头痛，神志不清而入院，高热头痛，抽搐3次后神志不清。查体：T40℃，BP140/80mmHg。神志不清，全身散在瘀点，颈抵抗，克氏征及巴氏征均阳性。脑脊液检查颅压240mmH₂O，外观混浊，WBC1200✕10⁶/L，蛋白质1.5g/L，糖1.5mmol/L，氯化物100mmol/L。为尽快明确诊断应首先检测
A. 脑积液涂片
B. 脑积液培养
C. 大便常规
D. 大便培养
E. 乙脑IgM抗体检测

正确答案：A。脑积液涂片